男，35岁。右上第一磨牙牙髓治疗后劈裂，拔牙过程中牙冠碎裂至龈下，牙根与周围骨质粘连，此时拔除此根应先分根后拔除。拔牙过程中发现其腭侧根消失，牙槽窝空虚，此时应当立即停止操作，拍X线片。如果确定腭根已入上颌窦，经去除牙槽间隔后扩大牙槽窝将其冲出，此时上颌窦底黏膜破裂口约7mm，此时应
A. 立即行上颌窦瘘修补术
B. 牙槽窝填塞碘仿纱条
C. 可不予处理
D. 给予抗生素，延期行上颌窦瘘修补术
E. 术后牙槽窝内放置碘仿海绵

正确答案：A。立即行上颌窦瘘修补术

解析：本题考查口腔上颌窦交通的处理方法。口腔上颌窦交通如为小的穿孔（直径2mm左右），可按拔牙后常规处理，使牙槽窝内形成以高质量的血凝块，待其自然愈合（C错）。中等大小穿孔（直径2～6mm）也可按上述方法处理，如将两侧牙龈拉拢缝合，进一步固定保护血凝块，更有利于自然愈合。交通口大于7mm,需用邻近组织瓣关闭创口（A对）。如果拔牙后，牙槽窝空虚填塞碘仿纱条，防止感染，不能起到修补上颌窦瘘的作用（B错）。可以给予抗生素，但延期上颌窦瘘修补术会影响愈合（D错）。采用明胶海绵加碘仿（E错）预防拔牙术后出血、疼痛、肿胀、感染及干槽症等并发症的临床效果，不能修补上颌窦瘘。